龋病是牙硬组织发生的
A. 急性进行性破坏
B. 急性间歇性破坏
C. 慢性进行性破坏
D. 慢性间歇性破坏
E. 以上各种破坏均存在

正确答案：C。慢性进行性破坏

解析：本题考查龋病。龋病是一种多因素疾病，牙体硬组织发生慢性进行性破坏（C对），主要特征是牙体硬组织在色、形、质各方面逐渐发生的进行性的过程。初期牙龋坏部位硬组织脱矿，釉质呈白垩色。继之病变部位色素沉着，局部呈黄褐色棕褐色。随着无机成分脱矿、有机成分破坏分解的不断进行，釉质和牙本质疏松软化，最终形成龋洞。